分泌不足引起血钙降低
A. 甲状腺
B. 肾上腺
C. 垂体
D. 甲状旁腺
E. 松果体

正确答案：D。甲状旁腺

解析：甲状旁腺（D对）分泌甲状旁腺素，主要作用是调节体内钙和磷的代谢。在甲状旁腺素和降钙素的共同调节下，维持机体血钙的稳定。当甲状旁腺激素分泌不足时，可引起血钙降低。